涉及人类受试者医学研究的伦理准则是
A. 悉尼宣言
B. 赫尔辛基宣言
C. 贝尔蒙报告
D. 东京宣言
E. 吉吉汉宣言

正确答案：B。赫尔辛基宣言

解析：最具影响力和普遍性的伦理文献是《赫尔辛基宣言-涉及人的医学研究的伦理准则》（B对）。《悉尼宣言》中有关于死亡的确定（A错）。《贝尔蒙报告》是1978年4月18日发表的伦理研究的经典文件，有3个基本伦理原则是相关的科研人员和机构审查委员会的成员必需遵守的：尊重人、有利、公正（C错）。《东京宣言》关于对拘留犯和囚犯给予折磨、虐待、非人道的对待和惩罚时，医师的行为准则（D错）。《吉汉宣言》国际生命伦理学会科学委员会坚决主张科技必须考虑公共利益（E错）。